大多数真菌繁殖与产毒的最适宜温度为
A. 20℃以下
B. 20～25℃
C. 25～30℃
D. 30～35℃
E. 35～40℃

正确答案：C。25～30℃

解析：本题考查大多数真菌繁殖与产毒的最适宜温度。大多数真菌繁殖与产毒的最适宜温度为25～30℃（C对ABDE错）。